根据《中华人民共和国价格法》，经营者定价应当遵循的原则是
A. 公平、合法和符合价值规律
B. 公平、合法和诚实信用
C. 公平、符合价值规律和诚实信用
D. 合法、符合价值规律和诚实信用
E. 公平、合法、符合价值规律和诚实信用

正确答案：D。合法、符合价值规律和诚实信用